某男，55岁，患风湿痹痛10年，今日又患膏淋，尿如米泔，宜选用的药是
A. 萆薢
B. 桑枝
C. 防己
D. 徐长卿
E. 海金沙

正确答案：A。萆薢

解析：本题考查的是萆薢的主治病证。患风湿痹痛10年，今日又患膏淋，尿如米泔，宜选用的药是萆薢（A对）。萆薢：【主治病证】（1）膏淋，白浊。（2）湿盛带下。（3）风湿痹痛。桑枝（B错）：【主治病证】（1）风湿痹痛。（2）水肿，脚气浮肿。防己（C错）：【主治病证】（1）风湿痹痛，尤以热痹为佳。（2）水肿，腹水，脚气浮肿，小便不利。徐长卿（D错）：【主治病证】（1）风湿痹痛，脘腹痛，牙痛，术后痛，癌肿痛。（2）跌打肿痛。（3）风疹，湿疹，顽癣。（4）毒蛇咬伤。海金沙（E错）：【主治病证】（1）热淋，血淋，石淋，膏淋。（2）水肿。